从一个呈正态分布的总体中随机抽样，`x≠μ，该差别被称为
A. 系统误差
B. 个体差异
C. 过失误差
D. 抽样误差
E. 测量误差

正确答案：D。抽样误差

解析：`x为样本均数，属于样本指标，μ为总体均数，属于总体参数，随机抽样研究中，由于抽样而引起的样本指标与总体参数间的相差，该差别为抽样误差（D对）。统计学中的误差包括随机误差和非随机误差，随机误差包括抽样误差和测量误差，测量误差指对同一观察单位某项指标在同一条件下进行反复测量所产生的误差（E错）。系统误差和过失误差均为非随机误差，系统误差可产生于设计人员、调查者或调查对象，也可由于设计考虑不当，资料搜集不准，汇总、计算有误等造成（A错）：过失误差指由于工作人员责任心不强，检查核对制度不严，或故意修改等而造成的检查、记录、观察、录入数据错误等而产生（C错）。个体差异为个体值之间的变异（B错）。